来源于百合科植物鳞茎的药材是
A. 香附
B. 玉竹
C. 浙贝母
D. 射干
E. 天冬

正确答案：C。浙贝母

解析：本题考查的是浙贝母的来源。来源于百合科植物鳞茎的药材是浙贝母（C对）。浙贝母：【来源】为百合科植物浙贝母的干燥鳞茎。香附（A错）：【来源】为莎草科植物莎草的干燥根茎。玉竹（B错）：【来源】为百合科植物玉竹的干燥根茎。射干（D错）：【来源】为鸢尾科植物射干的干燥根茎。天冬（E错）：【来源】为百合科植物天冬的干燥块根。